检查黄芪中有机氯农药残留量所用的测定方法是
A. 气相色谱法
B. 原子吸收分光光度法
C. 高效液相色谱法
D. 红外分光光度法
E. 薄层色谱法

正确答案：A。气相色谱法

解析：本题考查的是气相色谱法。检查黄芪中有机氯农药残留量所用的测定方法是气相色谱法（A对）。《中国药典》采用气相色谱法测定中药中部分有机氯类农药残留量、有机磷类农药残留量和拟除虫菊酯类农药残留量，质谱法测定农药多残留量。重金属的检查：重金属是指在实验条件下能与硫代乙酰胺或硫化钠作用显色的金属杂质，如铅、镉、汞、铜等。测定重金属总量用硫代乙酰胺或硫化钠显色反应比色法，测定铅、镉、汞、铜重金属元素采用原子吸收光谱法（B错）和电感耦合等离子体质谱法。《中国药典》一部规定，矿物药如石膏、芒硝含重金属不得过10mg/kg，玄明粉不得过20mg/kg；动物药如地龙含重金属不得过30mg/kg等。黄曲霉毒素的检查：黄曲霉毒素为黄曲霉等的代谢产物，是强烈的致癌物质。各国对食品和药品中黄曲霉毒素的限量都作了严格的规定，但目前还没有公认的植物药中黄曲霉毒素的限量标准。《中国药典》采用高效液相色谱法（C错），结合柱后衍生法和高效液相-串联质谱法测定药材、饮片及制剂中的黄曲霉毒素。红外分光光度法（D错）是鉴别化合物和确定物质结构的常用手段之一。在药物分析中，以红外光谱具有的“指纹”特性作为药物鉴定的依据，是各国药典共同采用的方法，但通常仅限于西药等单组分、单纯化合物的鉴定。薄层色谱法（E错）系将供试品溶液点于薄层板上，在展开容器内用展开剂展开，使供试品所含成分分离，所得色谱图与适宜的对照物（对照品或对照药材）按同法所得的色谱图对比，并可用薄层扫描仪进行扫描，用于鉴别、检查或含量测定。薄层色谱法因其快速、简便和灵敏，是目前中药鉴定中用于定性鉴别使用最多的色谱法之一。